女性，27岁。停经40天，人工流产术中诉心慌、胸闷，面色苍白，测血压90/60mmHg，心率56次/分，考虑诊断为
A. 子宫穿孔
B. 人工流产综合征
C. 吸宫不全
D. 漏吸
E. 羊水栓塞

正确答案：B。人工流产综合征

解析：该患者停经40天，人工流产术中诉心悸、胸闷，面色苍白。血压下降，心动过缓（人工流产综合反应指手术时疼痛或局部刺激，使受术者在术中或术毕出现恶心呕吐、心动过缓、心律不齐、面色苍白、头昏、胸闷、大汗淋漓，严重者甚至出现血压下降、昏厥、抽搐等迷走神经兴奋的症状），考虑诊断为人工流产综合征（B对）。子宫穿孔（P383-P384）（A错）表现为手术时突然感到无宫底感觉，或手术器械进入深度超过原来所测得深度。吸宫不全（P384）（C错）是指手术后阴道流血时间长，血量多或流血停止后再现多量流血。漏吸（P384）（D错）是指施行人工流产术未吸出胚胎及绒毛而导致继续妊娠或胚胎停止发育。羊水栓塞（P384）（E错）少见，往往由于宫颈损伤、胎盘剥离使血窦开放，为羊水进入创造条件，即使发生羊水栓塞，其症状及严重性不如晚期妊娠发病凶猛。